牙周系统治疗中贯穿始终的是
A. 调整咬合
B. 龈上、下洁治
C. 根面平整
D. 菌斑控制
E. 给药治疗

正确答案：D。菌斑控制

解析：本题考查牙周基础治疗。菌斑是牙周病的始动因子，控制菌斑能明显减轻牙周组织炎症，是其他治疗的基础，因此在基础治疗、手术治疗、修复治疗、支持治疗的整个牙周系统治疗贯穿始终的是菌斑控制（D对）。调整咬合（A错）在基础治疗阶段一般在炎症消退后，牙齿基本无松动的情况下进行。龈上、下洁治（B错）只在基础治疗阶段进行。根面平整（C错）在基础治疗阶段洁治术后进行。给药治疗（E错）在基础治疗的同时进行，并不是在牙周系统治疗中贯穿始终。